下列各项，可见咳嗽痰多，色黄稠黏，喉中痰鸣症状的是
A. 风寒咳嗽
B. 风热咳嗽
C. 痰热咳嗽
D. 痰湿咳嗽
E. 气虚咳嗽

正确答案：C。痰热咳嗽

解析：风寒咳嗽痰白清稀，伴恶寒发热等外感症状（A错）。风热咳嗽伴有发热恶风，头痛等外感症状（B错）。咳嗽痰多，色黄稠粘，喉中痰鸣为痰热之象，痰壅气道所致，故见于痰热咳嗽（C对）。痰湿咳嗽痰色白而稀，喉间痰声辘辘（D错）。气虚咳嗽咳而无力，痰白清稀，伴气短懒言，语声低微，自汗畏寒（E错）。